元气运行的通道是
A. 脉外
B. 三焦
C. 心脉
D. 胸腔
E. 全身

正确答案：B。三焦

解析：元气以三焦为通路而布达全身，内而五脏六腑，外而肌肤孔窍，无出不至（B对E错）。卫气不受脉道的约束，运行于脉外（A错）；宗气积聚于胸中，贯注心脉，推动血行（CD错）。